空气中氧浓度下降，危及生命的浓度是
A. 0.08
B. 0.09
C. 0.1
D. 0.11
E. 0.12

正确答案：A。0.08

解析：本题考查空气中危及生命的氧浓度。一般来说，空气中的氧含量为21%，也就是说，空气中每立方米的氧气浓度为21%。根据国家卫生部的规定，我国室内空气中氧含量最低不能低于18%，即空气中每立方米的氧气浓度不低于0.18，若极端情况下空气中氧浓度降到0.08（A对BCDE错），这时就会发生危及生命的情况。